下述哪种方法不是用于生存数据的分析方法
A. 寿命表法
B. Kaplan-Meier法
C. Log-rank检验
D. Breslow检验
E. 卡方检验

正确答案：E。卡方检验

解析：本题考查生存数据的分析方法。生存数据的分析方法包括：①寿命表法（A对）；②Kaplan-Meier法（B对）；③Log-rank检验（C对）；④Breslow检验（D对）。卡方检验（E错，为本题正确答案）不能进行生存数据的分析。